诊断心肌坏死最敏感的首选标志物是
A. 血清CK-BB
B. 血清CK-MB
C. 血清肌钙蛋白
D. 血清CK-MM
E. 血清肌酸激酶

正确答案：C。血清肌钙蛋白

解析：本题考查的是心肌肌钙蛋白（cTnI）的临床意义。诊断心肌坏死最敏感的首选标志物是血清肌钙蛋白（C对）。肌钙蛋白（cTn）是诊断心肌坏死最特异和敏感的首选标志物，cTnI是其中之一，其生理作用是抑制肌动蛋白中的ATP酶活性，使肌肉松弛，防止肌纤维收缩。当心肌损伤时，cTnI可以释放入血，血清cTnI浓度变化可以反映心肌损伤的程度。血清cTnI升高有临床意义。肌酸激酶（CK）（E错）主要存在于胞质和线粒体中，以骨骼肌和心肌最多，其次是脑组织和平滑肌，肝脏、胰腺和红细胞中有极少含量。血清CK活性增高有临床意义。肌酸激酶同工酶：CK是由B和M两个亚单位组成的二聚体，形成3个不同的亚型：①CK-MM（D错），主要存在于骨骼肌以及其他肌肉中；②CK-MB（B错），主要存在于心肌中；③CK-BB（A错），主要存在于脑、前列腺、肺、肝、肠等组织中。正常血清中绝大部分为CK-MM的活力，CK-MB活力不超过总活力的5%，CK-BB则微乎其微。血清CK同工酶升高有临床意义。